导致出生缺陷率增加的危险因素中，环境因素单独作用的比例为
A. 0.2
B. 0.1
C. 0.3
D. 0.4
E. 0.6

正确答案：B。0.1

解析：本题考查环境污染与致畸危害的相关内容。导致出生缺陷率增加的因素中，遗传因素（染色体异常及基因遗传病等）占25%，环境因素（药物、环境化学物、物理因素等）占10%（B对ACDE错），遗传与环境因素相互作用及原因不明者占65%。